与普通人相比，低温环境下人群膳食能量推荐需要量提高
A. 5%～10%
B. 10%～15%
C. 15%～20%
D. 25%～30%
E. 35%～40%

正确答案：B。10%～15%

解析：本题考查低温环境下人群膳食能量推荐需要量。与普通人相比，低温环境下人群膳食能量推荐需要量提高10%～15%（B对ACDE错）。